下列关于药品标准的说法，错误的是
A. 《中国药典》为法定药品标准
B. 生产企业执行的药品注册标准一般不得高于《中国药典》的规定
C. 医疗机构制剂标准作为省级地方标准仍允许保留，属于有法律效率的药品标准
D. 局颁药品标准收载的品种是国内已有生产、疗效较好，需要统一标准但尚未载入药典的品种

正确答案：B。生产企业执行的药品注册标准一般不得高于《中国药典》的规定

解析：本题考查的是药品标准。药品注册标准应当符合《中国药典》通用的技术要求，不得低于《中国药典》的规定（B错，为本题正确答案）。药品注册标准：药品注册标准是指国家药品监督管理部门核准给申请人特定药品的质量标准。药品应当符合国家药品标准和经国家药品监督管理局核准的药品质量标准。药品注册标准应当符合《中国药典》通用的技术要求，不得低于《中国药典》的规定。申报品种的检测项目或者指标不适用《中国药典》的，申请人应当提供充分的支持性数据。药品标准分为法定标准和非法定标准两种。法定标准是包括中国药典在内的国家药品标准和经国务院药品监督管理部门核准的药品质量标准（A对）；非法定标准有行业标准、团体标准、企业标准等。法定标准属于强制性标准，是药品质量的最低标准，拟上市销售的任何药品都必须达到这个标准；企业标准只能作为企业的内控标准，各项指标均不得低于国家药品标准。我国药品标准经历了多次变化。最新的变化是2001年颁布实施的《药品管理法》第32条规定“药品必须符合国家药品标准”，明确取消了地方药品标准。原地方药品标准经审查符合《药品管理法》有关规定的，经过批准后上升并纳入国家药品标准，以解决不同地区生产的相同名称药品存在不同标准或者相同药品不同名称的问题。但考虑到各地中药习惯用法不同和医疗机构制剂的特殊性，国家规定中药饮片和医疗机构制剂标准作为省级地方标准仍允许保留，可以作为有法律效力的药品标准（C对）。但对中药饮片，有国家药品标准的，必须按照国家药品标准炮制；国家药品标准没有规定的，才可以按照省级药品标准炮制。为了促进药品生产，提高药品质量和保证用药安全，除《中国药典》收载的国家药品标准外，尚有《国家食品药品监督管理局国家药品标准》（简称“局颁药品标准”，或“局颁标准”），也收载了国内已有生产、疗效较好，需要统一标准但尚未载入药典的品种质量标准（D对）。